在原料奶中加入适量的乳酸菌发酵剂或凝乳酶，排除乳清后的产品是
A. 超高温灭菌乳
B. 奶油
C. 奶酪
D. 调制乳
E. 淡炼乳

正确答案：C。奶酪

解析：本题考查奶酪。奶酪（C对ABDE错）是一种营养价值较高的发酵乳制品，是在原料奶中加入适量的乳酸菌发酵剂或凝乳酶，使蛋白质发生凝固，并加盐、压榨排除乳清之后的产品。